以下关于下颌舌骨肌的叙述中，不恰当的是
A. 起于下颌骨内面的内斜线全程
B. 构成肌性与功能性口底
C. 可上提口底
D. 具有上提下颌骨的作用
E. 下颌舌骨肌受下颌神经的下颌舌骨肌神经支配

正确答案：D。具有上提下颌骨的作用

解析：本题考查下颌舌骨肌。以下关于下颌舌骨肌的叙述中，不恰当的是具有上提下颌骨的作用（D错，为本题正确答案）。该肌还具有上提舌骨和下降下颌骨的作用。下颌舌骨肌起于下颌骨内面的内斜线全程（A对），构成肌性与功能性口底（B对），可上提口底（C对），下颌舌骨肌受下颌神经的下颌舌骨肌神经支配（E对）。